下述不良反应哪项是胰岛素不具有的
A. 过敏反应
B. 低血糖症
C. 胰岛素抵抗
D. 脂肪萎缩
E. 肝损伤

正确答案：E。肝损伤

解析：胰岛素的不良反应为：低血糖症（一般为胰岛素过量所致，是最重要、最常见的不良反应）；过敏反应（反应轻微，偶可引起过敏性休克）；胰岛素抵抗（分为急性抵抗性与慢性抵抗性）；脂肪萎缩（多见于注射部位）。掌握“胰岛素、磺酰脲类及双胍类药”知识点。